患者，男，45岁。胁痛口苦，胸闷纳呆，恶心、呕吐，目黄身黄，舌苔黄腻，脉弦滑数。其证候是
A. 肝气郁结
B. 肝郁化火
C. 肝胆湿热
D. 肝阴不足
E. 瘀血阻滞

正确答案：C。肝胆湿热

解析：题中患者以胁痛口苦为主症，故诊断为胁痛。胁痛口苦，胸闷为湿热蕴结肝经，肝络失和，疏泄失职所致。湿热中阻，升降失常，故纳呆，恶心，呕吐；肝病及胆，胆汁外溢，故身目发黄；舌苔黄腻，脉弦滑数为肝经湿热之象，故辨为肝胆湿热证。胁痛肝气郁结证为胸胁胀痛，走窜不定兼气滞证（A错）。肝郁化火为灼痛，口干、口苦，心烦，无湿象（B错）。题中辨证为肝胆湿热证（C对）。肝阴不足多为胁肋隐痛，伴心中烦热，口干咽燥，脉多细（D错）。瘀血阻滞为胁肋刺痛，痛有定处，拒按，面色晦暗，舌质紫暗，脉多沉涩（E错）。